下列不属于截根术适应证的说法的是
A. 多根牙的某一个或两个根（上颌磨牙）有Ⅲ度或Ⅳ度根分叉病变，其余牙根较轻，牙齿松动不明显
B. 磨牙的一个根发生纵裂或横折，而其他根完好
C. 下颌磨牙根分叉区Ⅲ度或Ⅳ度病变，局部的深牙周袋不能消除者
D. 磨牙的一个根有严重的根尖病变，器械折断不能取出，影响根尖病变的治愈
E. 牙周-牙髓联合病变，有一根明显受累，患牙可以进行彻底的根管治疗

正确答案：C。下颌磨牙根分叉区Ⅲ度或Ⅳ度病变，局部的深牙周袋不能消除者

解析：截根术的适应证：①多根牙的某一个或两个根（上颌磨牙）的牙周组织破坏严重，且有Ⅲ度或Ⅳ度根分叉病变，而其余牙根病情较轻，牙齿松动不明显者。②磨牙的一个根发生纵裂或横折，而其他根完好者。③磨牙的一个根有严重的根尖病变，根管不通或器械折断不能取出，影响根尖病变的治愈者。④牙周-牙髓联合病变，有一根明显受累，患牙可以进行彻底的根管治疗。掌握“根分叉病变”知识点。